混合性牙瘤的好发部位是
A. 下颌前磨牙区
B. 上颌磨牙区
C. 上颌切牙区
D. 上颌尖牙区
E. 下颌尖牙区

正确答案：A。下颌前磨牙区

解析：混合性牙瘤上下颌骨均可发生，以下颌前磨牙区和磨牙区多见；而组合性牙瘤好发于上颌切牙-尖牙区。掌握“牙瘤”知识点。